X连锁无丙种球蛋白血症是属于
A. T细胞缺陷
B. 联合免疫缺陷
C. 吞噬细胞缺陷
D. 补体系统缺陷
E. B细胞缺陷病

正确答案：E。B细胞缺陷病